激活的凝血因子VⅡa与组织因子(TF)复合物可激活
A. 凝血因子V和凝血因子X
B. 凝血因子X和凝血因子IX
C. 凝血因子Ⅲ和凝血因子VⅢ
D. 凝血因子XI和凝血因子XⅡ
E. 凝血因子IX和凝血因子XI

正确答案：B。凝血因子X和凝血因子IX

解析：凝血因子X和凝血因子IX（B对ACDE错）可以被激活的凝血因子VⅡa与组织因子(TF)复合物TF-Vlla激活，FlXa与VIII a、PL-Ca2+还可被TF-Vlla激活。